参与翼静脉丛构成的静脉是
A. 颞深静脉
B. 脑膜中静脉
C. 上下牙槽静脉
D. 腭降静脉
E. 以上均包括

正确答案：E。以上均包括

解析：翼丛位于颞下窝内，相当于上颌结节后上方处，分布于颞肌及翼内、外肌之间，凡与上颌动脉分支伴行的静脉，例如脑膜中静脉、颞深静脉、腭降静脉、上下牙槽静脉、翼肌与咬肌静脉等均参与此静脉丛的构成。掌握“口腔颌面颈部主要静脉的回流途径与范围”知识点。